实验设计的对照原则的原因为
A. 控制非实验因素的干扰，显现实验因素效应
B. 提高实验效应
C. 控制实验因素的干扰，增强可比性
D. 提高组间均衡性
E. 保证组间均衡性

正确答案：A。控制非实验因素的干扰，显现实验因素效应

解析：实验设计的对照原则的原因为控制非实验因素的干扰，显现实验因素效应（A对）。